沿界沟的前方排列成一行的是
A. 丝状乳头
B. 菌状乳头
C. 轮廓乳头
D. 叶状乳头
E. 味蕾

正确答案：C。轮廓乳头

解析：轮廓乳头：约10个左右，沿界沟的前方排列成一行。掌握“口腔黏膜分类及组织结构”知识点。